女，62岁。干咳、呼吸困难2周，逐渐加重，现不能平卧，无发热。查体：R24次/分，BP85/70mmHg，端坐位，颈静脉怒张，双肺呼吸音清，心浊音界向两侧扩大，心率108次/分，律齐，心音低而遥远，心脏各瓣膜区未闻及杂音，奇脉。心电图：窦性心动过速，各导联QRS波低电压。该患者最关键的治疗措施是
A. 静脉滴注抗生素
B. 静脉滴注硝酸甘油
C. 口服美托洛尔
D. 心包穿刺
E. 静脉注射呋塞米

正确答案：D。心包穿刺

解析：患者老年女性，有逐渐加重的呼吸困难症状，现不能平卧（端坐呼吸典型症状，提示肺部淤血严重）；查体：BP85/70mmHg（正常值90～139/60～89mmHg，血压下降），脉压（收缩压与舒张压之差，正常值30～40mmHg）变小，且伴有颈静脉怒张、心浊音界向两侧扩大、心音低而遥远和奇脉（均为心包积液引起心脏压塞时的常见体征）；心电图：窦性心动过速，各导联QRS波低电压（心包积液的常见心电图表现），结合患者的临床表现、典型体征和心电图表现，该患者考虑诊断为心包积液引起的心脏压塞。此时该患者最关键的治疗措施是心包穿刺（D对）开窗引流，迅速解除心脏压塞。静脉滴注抗生素（A错）主要用于早期针对急性心包炎的病因治疗。静脉滴注硝酸甘油（B错）、静脉注射呋塞米（E错）多用于急性心力衰竭（P175）的治疗。口服美托洛尔（C错）为β受体阻滞剂，可降低心率，改善心肌重塑，多用于治疗高血压、冠心病等疾病。